患者，女，69岁，近1个月出现入睡困难，白天有头昏、疲倦等不适感，尝试非药物治疗无改善，推荐的药物治疗方案是
A. 唑吡坦5mg po qn
B. 苯巴比妥100 mg po qn
C. 地西泮5mg po qn
D. 氯硝西泮2mg po qn
E. 艾司唑仑1mg po qn

正确答案：A。唑吡坦5mg po qn

解析：本题考查抗失眠药的合理应用。非苯二氮䓬类药物（唑吡坦（A对）、佐匹克隆、右佐匹克隆、扎来普隆）或褪黑素受体激动剂（雷美尔通、阿伐美拉汀）为非药物治疗无改善时，老年失眠患者推荐使用的药物。苯巴比妥（B错）、地西泮（C错）、氯硝西泮（D错）、艾司唑仑（E错）等均属于苯二氮䓬类药物，老年患者使用时需谨慎，若发生共济失调、意识模糊、反常运动、幻觉、呼吸抑制时应立即停药并妥善处理，同时注意防范跌倒等意外伤害。